女，36岁。发作性血压升高8个月，发作时血压为210/110mmHg，伴面色苍白，大汗，心悸。发作间歇期血压正常。最有助于诊断的是
A. 螺内酯试验阳性
B. 地塞米松抑制试验阳性
C. 颅内蝶鞍X线检查阳性
D. 血压增高时血和尿儿茶酚胺及香草基杏仁酸水平明显增高
E. 血压增高时血和尿17-羟类固醇及17-酮类固醇水平明显增高

正确答案：D。血压增高时血和尿儿茶酚胺及香草基杏仁酸水平明显增高

解析：青年女性患者，出现阵发性高血压，发作时血压达210/110mmHg，发作间期血压正常。发作同时伴有面色苍白，大汗，心悸，此为嗜铬细胞瘤的特征性表现，所以考虑诊断为嗜铬细胞瘤。嗜铬细胞瘤可间断地释放大量儿茶酚胺，引起阵发性高血压（P710），因此嗜铬细胞瘤高血压发作期间血和尿中儿茶酚胺以及其代谢产物VMA（香草基杏仁酸）会升高，有助于本病的诊断（D对）。螺内酯试验（A错）常用于原发性醛固酮增多症的检测，原发性醛固酮增多症血压一般呈持续性增高，并出现低血钾症状（如肌无力，周期性瘫痪，肢端麻木等）（P703）。地塞米松抑制试验（B错）主要用于库欣综合征的诊断及鉴别诊断，库欣综合征（P699）典型症状为向心性肥胖、满月脸、多血质以及腹部紫纹和高血压等表现。颅内蝶鞍X线检查阳性（C错）主要见于垂体腺瘤，表现为异常内分泌及压迫邻近组织引起的症状（P656）。血压增高时血和尿17-羟类固醇及17-酮类固醇水平明显增高（E错）常见于库欣综合征。